男，32岁，慢性膀胱刺激症状伴终末血尿，应首先考虑
A. 膀胱结石
B. 急性膀胱炎
C. 膀胱肿瘤
D. 急性肾盂肾炎
E. 泌尿系结核

正确答案：E。泌尿系结核

解析：肾结核常发生于20-40岁的青壮年，男性较女性多见。随着病情的发展，可出现典型的临床表现，尿频尿急尿痛是肾结核的典型症状之一，血尿是肾结核的重要症状，常为终末血尿（E对）。急性膀胱炎（B错）发病突然，有尿痛、尿频、尿急等膀胱刺激症状。排空后仍有尿不尽感，排尿时尿道有烧灼感，常见终末血尿，有时为全程血尿，甚至有血块排出。膀胱肿瘤（C错）发病年龄大多数为50-70岁，血尿是膀胱癌最常见和最早出现的症状，约85%的病人表现为间歇性肉眼血尿，尿频、尿急、尿痛亦是常见的症状，多为膀胱肿瘤的晚期表现。急性肾盂肾炎（D错）突然发生寒战、高热，单侧或双侧腰痛，有明显的肾区压痛、肋脊角叩痛以及膀胱刺激症状。膀胱结石的典型症状为排尿突然中断，疼痛放射至远端尿道及阴茎头部，伴排尿困难和膀胱刺激症状，小儿常用手搓拉阴茎，跑跳或改变排尿姿势后，能使疼痛缓解，继续排尿。患者未提及典型的排尿突然中断，故不首先考虑膀胱结石（A错）。